腰痛发病的关键是
A. 寒湿
B. 湿热
C. 肾虚
D. 气滞
E. 血瘀

正确答案：C。肾虚

解析：内伤腰痛多由肾精气亏虚，腰府失其濡养、温煦。精气亏虚则肾气不充，偏于阴虚则腰府不得儒养，偏于阳虚则腰府不得温煦，故发生腰痛。内伤不外乎肾虚。而外感腰痛，风、寒、湿、热 诸邪，常因肾虚而乘客，内外二因，相互影响，痹阻经脉，发生腰痛。故腰痛发病的关键是肾虚（C对）。（ABD错）。至于劳力扭伤，则和瘀血有关，临床上亦不少见，但瘀血不是发病的关键。（E错）。